肛门指检不能摸到的结构是
A. 精囊腺
B. 前列腺
C. 输精管壶腹
D. 子宫颈口
E. 尿道球腺

正确答案：E。尿道球腺

解析：尿道球腺（E对）位于会阴深横肌内，位置较深，肛门指检不能触及。